具有运化水液功能的脏是
A. 肝
B. 心
C. 脾
D. 肺
E. 肾

正确答案：C。脾

解析：脾运化水饮是指脾能够将水饮化为津液，并将其吸收、转输到全身脏腑、四肢百骸的生理功能（C对）。脾转输津液的途径有四：一是“脾气散精，上输于肺”，通过肺气宣降输布全身；二是“以灌四傍”，向四周布散，发挥滋养濡润脏腑、四肢百骸的作用；三是脏腑气化后多余的水液，在脾的运化作用下，经过三焦，下输膀胱，成为尿液生成之源；四是通过脾胃气机升降之枢纽作用，使全身津液随气之升降而上腾下达。脾在中焦，为水液运化调节的枢纽，脾气健运，津液化生充足，输布正常，脏腑形体官窍得养。脾失健运，或为津液生成不足而见津亏之证，或为津液输布障碍而见水湿痰饮等病理产物，甚至导致水肿。肝的生理功能有肝主疏泄、肝主藏血（A错）；心的生理功能有心主血脉、心主神明（B错）；肺的生理功能有肺主气司呼吸、肺主通调水道、肺朝百脉（D错）；肾的生理功能有肾主藏精、肾主水、肾主纳气（E错）。